血浆中含量最多、缓冲能力最强的缓冲体系是
A. Na-Pr/H-Pr
B. Na₂HPO₄/NaH₂P0₄
C. NaHCO₃/H₂CO₃
D. K₂HPO₄/KH₂PO₄
E. KHCO₃/H₂CO₃

正确答案：C。NaHCO₃/H₂CO₃